肾病综合征主要辅助检查项目应是
A. 双肾B超
B. 双肾CT
C. 静脉肾盂造影
D. 肾动脉造影
E. 肾活检

正确答案：E。肾活检

解析：肾病综合征病理类型很多，病因、病理生理、治疗方法、预后各不相同，为明确诊断，常用肾活检明确疾病的病因病理，因此，肾病综合征主要辅助检查项目应是肾活检（E对）。双肾B超（A错）、双肾CT（B错）主要用于肾脏肿瘤、肾盂肾炎级肾结核等的诊断，对肾病综合征的诊断和治疗没有帮助。静脉肾盂造（C错）影用于诊断肾脏、输尿管及膀胱结核、肿瘤和泌尿系结石，确定结石的部位，了解有无阴性结石。肾动脉造影（D错）主要用于血管病变、肾脏肿瘤、肾盂积水。